为实现HFA/21century，世界卫生组织建议的四项行动纲领即卫生策略之一是
A. 在所有的环境中促进健康
B. 承认健康是一项基本人权
C. 将健康作为人类发展的中心
D. 消除个人之间和群体之间的不公平现象

正确答案：A。在所有的环境中促进健康

解析：本题考查世界卫生组织建议的四项行动纲领。世界卫生组织建议的四项行动纲领是：1.与贫困做斗争，不仅仅是为贫困人口提供他们赖以生存所必需的物质，更重要的是寻找一种机制让他们能够通过自救改变生存的环境。采取卫生干预措施，打破贫困和不健康的恶性循环。2.在所有的环境中促进健康（A对BCD错），包括生活、工作、娱乐和学习所需的环境。通过社会行动促进健康，通过媒体形象倡导健康。3.部门间的协调、协商和互利。卫生部门要敏感地意识到各个部门的动机，以便与之协调，实现在促进人类健康目标上的一致性。4.将卫生列入可持续发展规划。要使发展可以持续，必须使当代和后代受益；要使健康成为发展的中心内容，健康必须在可待续发展计划中优先考虑。